癫痫持续状态是指
A. 频繁性失神小发作
B. 连续大发作神志不清
C. 单侧肢体频繁抽搐
D. 肢体连续发生触电感
E. 长期用药仍经常发作

正确答案：B。连续大发作神志不清

解析：癫痫持续状态是指癫痫连续发作之间意识尚未完全恢复又频繁再发，或癫痫发作持续30分钟以上未自行停止，即连续大发作神志不清（B对）。频繁性失神小发作（A错）见于癫痫小发作。单侧肢体频繁抽搐（C错）见于局限性抽搐。肢体连续发生触电感（D错）见于肌阵挛性发作。长期用药仍经常发作（E错）可见于部分癫痫控制不佳患者。